营养性缺铁性贫血
A. 大细胞性贫血
B. 正细胞性贫血
C. 单纯小细胞性贫血
D. 小细胞低色素性贫血
E. 造血不良性贫血

正确答案：D。小细胞低色素性贫血

解析：本题考查营养性缺铁性贫血的相关内容。营养性缺铁性贫血属于小细胞低色素性贫血（D对ABCE错），指机体因为缺乏铁，造成血红蛋白合成减少，当人体缺乏铁时，血红蛋白不能够正常合成，血液中的红细胞无法正常携带氧气，人体不能获得足够的氧气，就会出现头晕、乏力、面色苍白，活动后感到心悸、气短、胸闷等贫血症状，导致的营养缺铁性贫血。